不属于苯二氮䓬类药物作用特点的是
A. 具有抗焦虑作用
B. 具有外周性肌松作用
C. 具有镇静作用
D. 具有催眠作用
E. 用于癫痫持续状态

正确答案：B。具有外周性肌松作用

解析：苯二氮䓬类的药理作用和临床应用：抗焦虑作用（A对），对各种原因引起的焦虑均有显著疗效，主要用于焦虑症；镇静催眠作用（CD对），用于失眠症和术前镇静；抗惊厥、抗癫痫作用，其中地西泮静脉注射是目前治疗癫痫持续状态的首选药物（E对）；中枢性肌肉松弛作用，可缓解人类大脑损伤所致的肌肉强直（B错，为本题正确答案）。